18岁以下儿童禁用的药品是
A. 青霉素类
B. 头孢菌素类
C. 碳青霉烯类
D. 大环内酯类
E. 喹诺酮类

正确答案：E。喹诺酮类

解析：本题考查氟喹诺酮类药的禁忌症。氟喹诺酮类（E对）药可影响幼年动物软骨发育，导致承重关节损伤，因此不宜用于骨骼系统未发育完全的18岁以下的儿童。青霉素类（A错）毒性较低，但有少数人对本类药物过敏，凡初次注射或停药3天后再用者，都应做皮肤过敏试验。使用大剂量青霉素可造成出血、引起中毒，不要随意加大剂量。头孢菌素类（B错）属繁殖期杀菌药。不良反应和毒副作用较低。碳青霉烯类（C错）不良反应为胃肠道反应，过敏反应。大环内酯类（D错）毒性较低，一般很少引起不良反应。